成人膳食脂肪适宜摄入量以占总能量百分比计算，为
A. 5%～8%
B. 10%～15%
C. 20%～30%
D. 35%～40%
E. 45%～50%

正确答案：C。20%～30%